男，8岁。肾病综合征初治，体重25kg，泼尼松每次25mg，每天2次，治疗2周后，水肿消失，4周时尿蛋白转阴。此时判断该患儿疗效为
A. 激素部分敏感
B. 激素依赖
C. 激素不耐受
D. 激素敏感
E. 激素耐药

正确答案：D。激素敏感

解析：激素治疗肾病综合征的疗效是按照使尿蛋白转阴所用的时间而定的，该患儿治疗2周后，水肿消失，4周时尿蛋白转阴（激素敏感型肾病≤4周），按照九版教材，该患儿疗效为激素敏感型（D对）。没有激素部分敏感（A错）和激素不耐受（C错）这样的分类。激素依赖是指对激素敏感，但连续2次减量或停药2周内复发，该患儿并没有复发（B错）。激素耐药是指＞4周尿蛋白仍呈阳性（E错）。